明目蒺藜丸的功能是
A. 滋阴补肾，清肝明目
B. 补益肝肾，活血明目
C. 活血化瘀，养肝明目
D. 清热散风，明目退翳
E. 泻火明目，利尿通便

正确答案：D。清热散风，明目退翳

解析：本题考查的是明目蒺藜丸的功能。明目蒺藜丸的功能是清热散风，明目退翳（D对）。明目蒺藜丸：【功能】清热散风，明目退翳。石斛夜光颗粒：【功能】滋阴补肾，清肝明目（A错）。功能为补益肝肾，活血明目（B错）、活血化瘀，养肝明目（C错）或泻火明目，利尿通便（E错）的中成药，2022年考试指南未明确说明。